最容易出现骨筋膜室综合征的是
A. 股骨颈骨折
B. 肱骨髁上骨折
C. 膝关节后脱位
D. 创伤性肩关节脱位
E. 桡骨远端骨折

正确答案：B。肱骨髁上骨折